流行性感冒产生全身症状的主要原因是
A. 流感病毒在细胞内进行复制
B. 病毒感染的宿主细胞发生变性坏死溶解或脱落，产生炎症反应
C. 肺充血
D. 气道高反应
E. 肺水肿

正确答案：B。病毒感染的宿主细胞发生变性坏死溶解或脱落，产生炎症反应

解析：流感病毒通常依靠HA与呼吸道表面纤毛柱状上皮细胞的特殊受体结合而进入细胞，在胞内进行复制。在NA的协助下新的病毒颗粒被不断释放并播散继续感染其他细胞，被感染的宿主细胞则发生变性、坏死、溶解或脱落，产生炎症反应，从而出现发热、头痛、肌痛等全身症状（B对）。